导致尿路感染最常见的致病菌是
A. 金黄色葡萄球菌
B. 大肠杆菌
C. 变形杆菌
D. 粪链球菌
E. 沙雷杆菌

正确答案：B。大肠杆菌

解析：尿路感染最常见的致病菌是大肠杆菌（B对）。金黄色葡萄球菌（A错）、变形杆菌（C错）、粪链球菌（D错）、沙雷杆菌（E错）均为尿路感染的致病菌，但不是最常见的致病菌。